医师何某在取得医师资格证书和执业证书后的一年里，擅自从事婚前医学检査、遗传病诊断和产前诊断，虽经卫生行政部门制止，仍不改正，并又施行终止妊娠手术。依据《母婴保健法》规定，应对何某给予的行政处罚是
A. 罚款
B. 没收违法所得
C. 没收非法财物
D. 吊销其执业证书
E. 行政拘留

正确答案：A。罚款

解析：《母婴保健法》规定，未取得国家颁发的有关合格证书，有下列行为之一的，县级以上地方人民政府卫生行政部门应当予以制止，并可根据情节给予警告或者处以罚款：①从事婚前医学检查、遗传病诊断或者医学技术鉴定的；②施行终止妊娠手术的；③出具法律规定的有关医学证明的。该医师未取得国家颁发的母婴保健技术相应合格证书，擅自从事婚前医学检查，产前诊断，虽然卫生部门制止，仍不改正，并实施终止妊娠手术，情节严重，应给予罚款（A对）。